人类辅助生殖技术带来的伦理问题应除外
A. 人类辅助生殖技术所生的孩子，其众多父母如何定位
B. 代孕技术可否允许使用
C. 精子、卵子、胚胎可否商品化
D. 有严重遗传病的新生儿可否实施安乐死
E. 非婚单身女性可否使用相应技术生育孩子

正确答案：D。有严重遗传病的新生儿可否实施安乐死